具有正性肌力与负性频率的抗心衰药是
A. 地高辛
B. 依那普利
C. 氢氯噻嗪
D. 卡维地洛
E. 硝普钠

正确答案：A。地高辛